止于跟骨的肌是
A. 胫骨后肌
B. 腘肌
C. 第三腓骨肌
D. 小腿三头肌
E. 胫骨前肌

正确答案：D。小腿三头肌

解析：胫骨后肌（A错）止于足舟骨粗隆及楔骨；腘肌（B错）止于胫骨比目鱼肌线以上骨面；小腿三头肌（D对）即腓肠肌和比目鱼肌，止于跟骨；胫骨前肌（E错）止于内侧楔骨内侧面、第1跖骨底。